可通过测定膨胀度进行鉴别的药材是
A. 葶苈子
B. 人参
C. 黄柏
D. 五味子
E. 西红花

正确答案：A。葶苈子

解析：本题考查的是中药材的膨胀度鉴定。可通过测定膨胀度进行鉴别的药材是葶苈子（A对）。膨胀度测定：膨胀度是药品膨胀性质的指标，是指每1g药品在水或其他规定的溶剂中，在一定的时间与温度条件下膨胀后所占有的体积（ml）。主要用于含黏液质、胶质和半纤维素类的天然药品。《中国药典》规定，车前子膨胀度不低于4.0；蛤蟆油膨胀度不低于55；南葶苈子膨胀度不低于3，北葶苈子膨胀度不低于12。人参（B错）等具树脂道，饮片皮部具棕黄色小点。黄柏（C错）饮片切面鲜黄色，含小檗碱，以味苦为好。五味子（D错）等果实、种子一般为类圆球形。西红花（E错）加水浸泡后，水液染成黄色，药材不变色。